六阳经原穴的位置，排列在哪穴之后
A. 井穴
B. 荥穴
C. 输穴
D. 经穴
E. 合穴

正确答案：C。输穴

解析：原穴是脏腑的原气输注经过和留止于十二经脉四支部的腧穴。十二经各有一原穴均分布在四肢腕踝关节附近。“阴经以输为原”，即阴经之原穴与五输穴中的腧穴同穴名、同部位，实为一穴。阳经之原穴位于五输穴中的输穴之后，即另置一原（C对ABDE错）。